关于符合树脂修复术色彩的叙述，错误的是
A. 色彩包括色相、明度和彩度三个要素
B. 色相是颜色的基本样貌
C. 明度决定于物体表面对光的反射率
D. 彩度是指颜色的鲜艳程度
E. 7种基本颜色总称为彩度

正确答案：E。7种基本颜色总称为彩度

解析：本题考查颜色的描述系统。关于符合树脂修复术色彩的叙述，错误的是7种基本颜色总称为彩度（E错，为本题的正确答案）。色彩包括色相、明度和彩度三个要素（A对）。色相是颜色的基本样貌（B对），也是红、橙、黄、绿、青、蓝、紫7种基本颜色的总称，是颜色彼此间区别的最基本特征。明度是各种颜色由明到暗的变化程度，决定于物体表面对光的反射率（C对）。彩度是指颜色的鲜艳程度（D对）。各种颜色中的纯色，其彩度最高。